女性，35岁，人工流产术后三个月阴道流血，hCG测定持续阳性。妇科检查：子宫如50天妊娠大小。肺部摄片见左上肺有圆形棉絮状阴影直径2cm，考虑最可能的诊断为
A. 侵蚀性葡萄胎
B. 吸宫不全
C. 功能失调性子宫出血
D. 绒毛膜癌
E. 子宫内膜癌

正确答案：D。绒毛膜癌

解析：35岁女性患者，人工流产后三个月阴道流血，hCG测定持续阳性（超过4周血清hCG仍持续高水平），子宫如50天妊娠大小（子宫增大），肺部摄片见左上肺有圆形棉絮状阴影直径2cm（流产后出现阴道流血和转移灶应考虑妊娠滋养细胞恶性肿瘤可能）（BCE错），根据患者临床症状、实验室检查和影像学诊断，应考虑诊断为绒毛膜癌（D对）。侵蚀性葡萄胎（A错）侵蚀子宫肌层，远处转移少见。